医务人员就医疗行为进行说明的首选对象是
A. 患者朋友
B. 患者同事
C. 患者所在单位领导
D. 患者本人
E. 患者亲属

正确答案：D。患者本人

解析：医务人员就医疗行为进行说明时，应尊重患者的知情同意权。在医疗活动中，患者的各项权利都是围绕患者自身展开的，因而应当以患者自身为主体，并以其为医疗活动告知主体，进行说明的首选对象是患者本人（D对）。